引起佝偻病的原因是
A. 维生素A缺乏
B. 维生素D缺乏
C. 维生素C缺乏
D. 维生素B缺乏
E. 维生素K缺乏

正确答案：B。维生素D缺乏

解析：当维生素D缺乏或转化障碍时，儿童骨钙化不良、骨骼变软，称佝偻病。掌握“脂溶性维生素”知识点。